“鱼与熊掌不可兼得”。这种动机冲突是
A. 双趋冲突
B. 双避冲突
C. 趋避冲突
D. 双重趋避冲突
E. 双趋双避冲突

正确答案：A。双趋冲突

解析：双趋冲突：指两种对个体都具吸引力的目标同时出现，而由于条件限制，个体无法同时采取两种行动所表现出的心理冲突。“鱼与熊掌不能兼得”，但又难以取舍。当两种目标的吸引力非常接近，解决冲突就比较困难。掌握“需要与动机”知识点。